一侧内囊损伤不会出现
A. 同侧半身浅感觉丧失
B. 对侧半深感觉丧失
C. 对侧上，下肢运动丧失
D. 对侧眼的颞部和同侧眼的鼻侧偏盲
E. 对侧面肌和舌肌瘫痪

正确答案：A。同侧半身浅感觉丧失

解析：内囊分前肢、膝和后肢三部分，前肢主要包括额桥束和由丘脑背内侧核投射到前额叶的丘脑前辐射，膝部有皮质核束，内囊后肢的投射纤维经豆丘部的下行纤维束为皮质脊髓束、皮质红核束和顶桥束等，上行纤维束是丘脑中央辐射和丘脑后辐射。因此，当内囊损伤广泛时，病人会出现对侧偏身感觉丧失（丘脑中央辐射受损），对侧偏瘫（皮质脊髓束、皮质核束损伤）和对侧偏盲（视辐射受损）的“三偏’症状”（A对）。